酸蚀的作用不包括
A. 去除表层玷污釉质
B. 减少表面粗糙度
C. 增加釉质表面自由能
D. 活化釉质表层
E. 增加牙表面积

正确答案：B。减少表面粗糙度

解析：本题考查酸蚀的作用。酸蚀的作用不包括减少表面粗糙度（B错，为本题的正确答案）。酸蚀可去除表面玷污层（A对），增加釉质表面可湿性和表面自由能（C对），有利于粘结剂的渗入。酸蚀可活化釉质表层（D对），增加釉质表面极性，使其易于与粘接树脂结合。酸蚀还可增加釉质表面的粘结面积（E对），以及釉质表面粗糙度。